胸痹重证，阴寒极盛者，其治法是
A. 散寒化痰通络
B. 理气通阳化瘀
C. 芳香温通止痛
D. 益气温阳散寒
E. 回阳救逆固脱

正确答案：C。芳香温通止痛

解析：胸痹阴寒极盛证为胸阳不振，阴寒之邪乘虚而入，阴占阳位，寒凝气滞，致使胸阳痹阻，气机不畅，心脉挛急而发病。治法当以宣痹温阳，芳香温通以止痛（C对）。阴寒极盛与痰无关，且散寒化痰通络法温通散寒之力不足（A错）。阴寒极盛者，无瘀象，为阴寒凝滞，故不适合理气通阳化瘀（B错）。阴寒极盛者，无气虚之象（D错）。阴寒极盛者非阳气欲脱，无手足厥逆的症状（E错）。